决定定量喷雾剂每揿喷射用量的是
A. 囊材
B. 抛射剂
C. 手动泵
D. 阀门系统
E. 耐压容器

正确答案：C。手动泵

解析：本题考查的是气雾剂与喷雾剂的构成。决定定量喷雾剂每揿喷射用量的是手动泵（C对）。气雾剂的构成：气雾剂由药物与附加剂、抛射剂、耐压容器和阀门系统构成。气雾剂雾滴（粒）的大小取决于抛射剂的类型、用量、阀门和推动钮的类型以及药液的黏度等。（1）药物与附加剂：①药物：中药气雾剂中的药物可以是饮片经提取分离制成的总提取物、有效部位或有效成分，或饮片制成的微粉。②附加剂：a.溶剂，某些脂溶性药物可以溶解于气雾剂的抛射剂中如氢氟烷烃、水、甘油或脂肪酸、植物油。b.潜溶剂，如乙醇、丙二醇等。c.抗氧剂，如维生素C、亚硫酸钠等。d.防腐剂，如羟苯乙酯等。e.表面活性剂，可作为乳化剂，如硬脂酸三乙醇胺皂、聚山梨酯类等；或助悬剂，如脂肪酸山梨坦类、月桂醇等。吸入气雾剂中所有附加剂均应对呼吸道黏膜和纤毛无刺激性、无毒性。非吸入气雾剂中所有附加剂均应对皮肤或黏膜无刺激性。（2）抛射剂（B错）：为适宜的低沸点液化气体。抛射剂是喷射药物的动力，有时兼作药物的溶剂和稀释剂。根据气雾剂所需压力，可将两种成几种抛射剂以适宜比例混合使用。①氢氟烷烃类；②二甲醚；③碳氢化合物；④惰性气体。（3）耐压容器（E错）：耐压容器必须性质稳定、耐压、价廉、轻便。常用的耐压容器有金属容器、破璃容器（外面搪有塑料防护层）和塑料容器。（4）阀门系统（D错）：阀门系统是调节药物和抛射剂从容器中流出量及速度的重要组成部分，其精密程度直接影响气雾剂给药剂量的准确性。①普通阀门；②定量阀门。喷雾剂的构成：喷雾剂由药物与附加剂、容器与手动泵构成。其中手动泵又分为定量型与非定量型。囊材（A错）为胶囊剂的组成部分。